普通感冒患者，有打喷嚏、流鼻涕的症状，宜选用的药物是
A. 对乙酰氨基酚滴剂
B. 右美沙芬片
C. 氯苯那敏片
D. 茶碱缓释片
E. 氟替卡松干粉吸入剂

正确答案：C。氯苯那敏片

解析：本题考查药物的适应证。氯苯那敏片（C对）属于抗组胺药，可以使下呼吸道的分泌物干燥和变稠，减少打喷嚏和鼻溢液；普通儿童感冒患者，体温升高（＞38.5℃）时宜选用对乙酰氨基酚滴剂（A错）；有单纯性咳嗽症状宜选用右美沙芬（B错）；茶碱缓释片（D错）属于磷酸二脂酶抑制剂类的平喘药；氟替卡松干粉吸入剂（E错）为吸入性糖皮质激素，用于持续性哮喘的长期治疗，季节性过敏性鼻炎（包括枯草热）和常年性过敏性鼻炎的预防和治疗。